鸠尾峡的宽度在后牙为颊舌尖距离的
A. 2/3～1/2
B. 1/2
C. 1/3～1/2
D. 1/4～1/3
E. 1/5～1/4

正确答案：D。1/4～1/3

解析：本题考查窝洞的结构-固位形。鸠尾峡的宽度在后牙为颊舌尖距离的1/4～1/3（D对）。鸠尾峡的宽度一般在后牙为所在颊舌尖间距的1/4～1/3，前牙为邻面洞舌方宽度1/3～1/2（C错）。